下列关于发育呈连续性又有阶段性的论述哪一个是错误的
A. 该过程既有量变又有质变
B. 各发育阶段顺序衔接，发育快的可以跳跃
C. 前一阶段为后一阶段打基础
D. 前一阶段发育受到障碍，可对后一阶段产生不良影响
E. 各发育阶段有各自的特点

正确答案：B。各发育阶段顺序衔接，发育快的可以跳跃

解析：本题考查体格生长的总规律。生长发育在整个儿童时期是不断进行的，不同年龄阶段的生长发育有一定特点（E对）。各年龄阶段按顺序衔接，前一年龄阶段的生长发育为后一年龄阶段的生长发育奠定基础（C对）。任何一个阶段的生长发育都不能跳跃（B错，为本题正确答案），任何一个阶段的生长发育受到障碍，都会影响后一阶段的生长发育（D对）。一般年龄越小体格增长越快，出生后以最初6个月生长最快，尤其是前3个月，第1年为生后的第一个生长高峰；第2年起逐渐减慢，到青春期又猛然加快（A对）。